关于保护人类受试者的伦理原则和准则是
A. 《贝尔蒙报告》
B. 《东京宣言》
C. 《赫尔辛基宣言》
D. 《纽伦堡法典》
E. 《吉汉宣言》

正确答案：A。《贝尔蒙报告》

解析：《贝尔蒙报告》是1978年4月18日发表的伦理研究的经典文件，有3个基本伦理原则是相关的科研人员和机构审查委员会的成员必需遵守的：尊重人、有利、公正（A对）。《东京宣言》关于对拘留犯和囚犯给予折磨、虐待、非人道的对待和惩罚时，医师的行为准则（B错）。最具影响力和普遍性的伦理文献是《赫尔辛基宣言-涉及人的医学研究的伦理准则》（C错）。1946年，纽伦堡国际军事法庭通过了著名的《纽伦堡法典》，制定了关于人体实验的基本原则：一是必须有利于社会；二是应该符合伦理道德和法律观点（D错）。《吉汉宣言》国际生命伦理学会科学委员会坚决主张科技必须考虑公共利益（E错）。